黄精的功效是
A. 益胃生津
B. 补肝明目
C. 补阴益气
D. 壮阳健骨
E. 软坚散结

正确答案：C。补阴益气

解析：本题考查的是黄精的功效。黄精的功效是补阴益气（C对）。黄精：【功效】滋阴润肺，补脾益气。石斛：【功效】养胃生津（A错），滋阴除热，明目，强腰。枸杞子：【功效】滋补肝肾，明目（B错），润肺。仙茅：【功效】补肾壮阳，强筋健骨（D错），祛寒除湿。鳖甲：【功效】滋阴潜阳，退热除蒸，软坚散结（E错）。